可抑制神经-肌肉接头传递作用的药物是
A. 左旋多巴
B. 甲磺丁脲
C. 卡那霉素
D. 水合氯醛
E. 灰黄霉素

正确答案：C。卡那霉素

解析：本题考查药物的相互作用。卡那霉素（C对）可抑制神经-肌肉接头传递作用；卡那霉素可与体内的钙离子络合，抑制节前神经末梢乙酰胆碱的释放并降低突触后膜对乙酰胆碱的敏感性，造成神经肌肉接头处传递阻断。